开口型是指
A. 下颌自大张口到闭口的整个过程中，下颌运动的轨迹
B. 下颌自闭口到张大的整个过程中，下颌运动的轨迹
C. 下颌自微张口到大张口的整个过程中，下颌运动的轨迹
D. 下颌前伸咬合时下颌运动的轨迹
E. 下颌侧方咬合时下颌运动的轨迹

正确答案：B。下颌自闭口到张大的整个过程中，下颌运动的轨迹

解析：本题考查开口型。开口型是指下颌自闭口到张大的整个过程中下颌运动的轨迹（B对AC错）。下颌前伸咬合时下颌运动的轨迹是下颌前伸运动（D错）。下颌侧方咬合时下颌运动的轨迹是下颌侧方运动（E错）。